患者，女，33岁，已婚。每于经期大便溏泄，脘腹胀满，神疲肢软，舌淡苔薄白，脉濡滑。治疗应首选
A. 参苓白术散
B. 健固汤
C. 柴胡疏肝散
D. 痛泻要方
E. 四苓散

正确答案：A。参苓白术散

解析：患者每于经期大便溏泄，故诊断为经行泄泻。经行气血下注血海，脾气益虚，不能运化水湿，湿渗大肠，则经期大便溏泄；脾虚运化失司，故脘腹胀满，神疲肢软。舌淡苔薄白，脉濡滑均为脾虚之象，故辨为脾虚证，治宜健脾渗湿，理气调经，首选参苓白术散（A对）。健固汤功能补脾渗湿，用于治疗经前泄水，可合四神丸治疗经行泄泻肾虚证（B错）。柴胡疏肝散功能疏肝行气，活血止痛，主治肝郁气滞证（C错）。痛泻药方功能补脾柔肝，祛湿止泻，主治脾虚肝旺之痛泻（D错）。四苓散功能健脾渗湿，主治脾胃虚弱，水湿水停证（E错）。